男，13岁。小学勉强毕业，现读初一。学习成绩差，不合群，且经常遭班里同学欺负，不愿去上学。精神检查发现患儿抽象思维能力、计算力、判断力均较差，言语表达词汇贫乏。IQ60。该患儿的诊断是
A. 儿童孤独症
B. 边缘智力
C. 中度精神发育迟滞
D. 儿童厌学症
E. 轻度精神发育迟滞

正确答案：E。轻度精神发育迟滞

解析：该患儿就读小学学习成绩差，精神检查发现抽象思维能力计算力判断力均较差，言语表达词汇贫乏，IQ60（轻度精神发育迟滞：IQ50～69），故诊断为轻度精神发育迟滞（E对） 。儿童孤独症起病于婴幼儿期，多数伴有智力低下，突出表现是语言发育障碍，明显的社会交往问题，与智力发育水平不相称，而精神发育迟滞的语言和社会交往能力与智力水平相称（A错）。中度精神发育迟滞IQ 35～49，与本例不符（C错）。